以下脏器中既属六腑之一，又属于奇恒之腑的是
A. 脑
B. 胆
C. 心包
D. 三焦
E. 膀胱

正确答案：B。胆

解析：胆的生理机能是传化物，生理特点是泻而不藏，实而不能满，故胆为六腑。胆是中空的囊状器官，内盛胆汁。胆形态中空、排泄胆汁参与消化类似六腑，但其内盛“精汁”则又与五脏“藏精”的生理特点相似，所以，胆具备似脏非脏，似腑非腑的特征，故又称为奇恒之腑。（B对）。脑（A错）、三焦（D错）、膀胱（E错）是奇恒之腑。